痢疾的传播媒介可以是
A. 生活物品
B. 水源
C. 食物
D. 苍蝇
E. 以上全是

正确答案：E。以上全是